患儿极度消瘦，皮肤干瘪起皱，毛发干枯，腹凹如舟，杳不思食。其治法是
A. 大补阴液
B. 调理脾胃
C. 补益气血
D. 益气健脾
E. 健脾补肾

正确答案：C。补益气血

解析：小儿极度消瘦，皮肤干瘪起皱，毛发干枯，腹凹如舟，杳不思食可诊断为干疳，治以补益气血的八珍汤加减（C对）。大补阴液用于阴津亏虚（A错）。调理脾胃用于脾胃不和（B错）。益气健脾用于气虚脾弱（D错）。健脾补肾用于脾肾阳虚（E错）。